清肺排毒汤是国家卫生健康委和国家中医药管理局针对新型冠状病毒感染性肺炎推出的中药复方。全方由麻黄、苦杏仁、生石膏先煎、桂枝、泽泻、猪苓、白术、茯苓、柴胡、黄芩、姜半夏、生姜、紫菀、款冬花、射干、细辛、山药、枳实、陈皮、藿香、炙甘草等组成。中医药专家认为COVID-19属于中医学的“寒湿疫”，基本病机是疫毒湿寒与伏燥搏结壅塞肺胸损伤正气导致气机痹阻升降失常元气虚衰。与麻黄同为该方君药善温肺化饮，用于咳喘的药是
A. 细辛
B. 陈皮
C. 藿香
D. 款冬花
E. 炙甘草

正确答案：A。细辛

解析：本题考查的是清肺排毒汤的方义简释。与麻黄同为该方君药善温肺化饮咳喘的药是细辛（A对）。细辛：【功效】祛风散寒，通窍，止痛，温肺化饮。陈皮（B错）：【功效】理气调中，燥湿化痰。广藿香（C错）：【功效】化湿，止呕，发表解暑。款冬花（D错）：【功效】润肺下气，止咳化痰。甘草（E错）：【功效】益气补中，祛痰止咳，解毒，缓急止痛，缓和药性。